衡量一个牙是否为良好基牙的最重要指标是
A. 牙槽骨的量
B. 牙槽骨的密度
C. 牙周膜面积
D. 牙根长度
E. 牙根数目

正确答案：C。牙周膜面积

解析：临床上，常用牙周膜面积大小来衡量是否为良好基牙。掌握“固定桥的生理基础”知识点。